某男，28岁，出租车司机。感冒2日，发热头痛，拟服药治疗。执业药师建议，该患者不宜选用含马来酸氯苯那敏的中成药是
A. 感冒软胶囊
B. 抗感灵片
C. 强力感冒片
D. 感速康胶囊
E. 新复方大青叶片

正确答案：D。感速康胶囊

解析：本题考查的是含西药组分的中成药。出租车司机。感冒2日，发热头痛，拟服药治疗。执业药师建议，该患者不宜选用含马来酸氯苯那敏的中成药是感速康胶囊（D对）。感速康胶囊：功能清热解毒，消炎止痛。用于风热感冒、流行性感冒及上呼吸道感染引起的头痛身痛，鼻塞流涕，咳嗽痰黄，咽喉肿痛，齿龈肿痛等。含西药成分：对乙酰氨基酚、马来酸氯苯那敏、维生素C。抗感灵片（B错）：功能解热镇痛，消炎。用于感冒引起的鼻塞，流涕，咽部痒痛，咳嗽头痛，周身酸痛，发热及由感冒引起的扁桃体炎。含西药成分：对乙酰氨基酚。强力感冒片（C错）：功能疏风解表，清热解毒。用于风热感冒，症见发热、头痛、口干、咳嗽、咽喉痛。含西药成分：对乙酰氨基酚。新复方大青叶片（E错）：功能清瘟，消炎，解热。用于伤风感冒、发热头痛、鼻流清涕、骨节酸痛。含西药成分：对乙酰氨基酚、异戊巴比妥、咖啡因、维生索C。感冒软胶囊（A错）所含西药成分，2022年考试指南未明确说明。感冒软胶囊：【药物组成】羌活、麻黄、桂枝、荆芥穗、防风、白芷、川芎、石菖蒲、葛根、薄荷、苦杏仁、当归、黄芩、桔梗。辅料为甘油、植物油、明胶、蜂蜡、食用色素。【功能】散风解热。【主治】用于外感风寒引起的头痛发热，鼻塞流涕，恶寒无汗，骨节酸痛，咽喉肿痛。